初产妇，26岁。规律宫缩13小时，已破膜。产科检查：枕左前位，胎心率92次/分，宫口开全，胎头S+3。该患者正确的处理措施是
A. 会阴侧切后产钳助娩
B. 吸氧、备血
C. 等待自然分娩
D. 会阴侧切后自然分娩
E. 行剖宫产

正确答案：A。会阴侧切后产钳助娩

解析：青年初产妇，宫口已开全，S+3（胎头已下降至坐骨棘平面以下3cm），说明能经阴道分娩，胎儿的心率92次（＜正常胎心率110～160bpm），说明胎儿出现缺氧，故应尽快终止妊娠，正确的处理措施是会阴侧切后产钳分娩（A对）。吸氧备血（B错）、等待自然分娩（C错）、会阴侧切后自然分娩（D错）均可能耽误最佳分娩时机而导致胎儿窘迫甚至危及胎儿生命。该胎头已下降至坐骨棘平面以下3cm，说明能经阴道分娩，一般不行剖宫产（E错）。